下颌舌侧牙槽嵴为垂直型，设计舌杆，位置应
A. 止于下前牙舌隆突上
B. 止于下前牙舌侧龈缘
C. 止于下前牙舌侧龈缘3mm处
D. 止于下前牙舌侧龈缘6mm处
E. 止于下前牙舌侧龈缘8mm处

正确答案：C。止于下前牙舌侧龈缘3mm处

解析：舌杆一般有三型：垂直型者舌杆与黏膜平行接触；与基牙牙长轴基本平行，边缘离开龈缘3～4mm，倒凹型者舌杆在倒凹区之上，或在倒凹区，但要留出空隙；斜坡型者舌杆与黏膜离开0.3～0.4mm，与牙槽嵴平行。舌杆的位置要适宜，既不影响舌的运动，也不妨碍口底的功能活动。如在前牙舌隆突上放置连续舌支托则称舌隆突杆，与舌杆合并使用则称双舌杆，对前牙可起支持作用，亦有增加游离端基托稳定的作用。掌握“局部义齿连接体”知识点。